特殊医学用途配方食品是指为满足进食受限、消化吸收障、代谢紊乱或者特定疾病状态人群对营养素或者膳食的特殊需要，专门加工配制而成的配方食品。关于特殊医学用途配方食品管理的说法，错误的是
A. 特殊医学用途配方食品参照药品管理，该类食品应当经过国家市场监督管理部门注册
B. 特殊医学用途配方食品广告参照药品广告的有关规定予以处理
C. 特殊医学用途配方食品注册号的格式为：国食注字TP+××××（4位年号）+××××（4位顺序号）
D. 特殊医学用途配方食品注册证书有效期为5年

正确答案：C。特殊医学用途配方食品注册号的格式为：国食注字TP+××××（4位年号）+××××（4位顺序号）

解析：本题考查特殊医学用途配方食品管理。特殊医学用途配方食品是指为满足进食受限，消化吸收障的、代谢紊乱或者特定疾病状态人群对营养素或者膳食的特殊需要，专门加工配制而成的配方食品。关于特殊医学用途配方食品管理的说法，错误的是特殊医学用途配方食品注册号的格式为：国食注字TP+×××（4位年号）+×××（4位顺序号）（C错，为本题正确答案）。特殊医学用途配方食品注册号的格式为：国食注字TY+4位年号+4位顺序号，其中TY代表特殊医学用途配方食品。特殊医学用途配方食品注册证书有效期为5年（D对）。《食品安全法》将特殊医学用途配方食品参照药品管理的要求予以对待，规定该类食品应当经国家市场监督管理部门注册（A对）。另外，特殊医学用途配方食品广告也参照药品广告的有关规定予以处理（B对）。